关于胃动脉来源，错误的是
A. 胃短动脉来自脾动脉
B. 胃左动脉来自腹腔干
C. 胃右动脉来自肝固有动脉
D. 胃网膜右动脉来自肠系膜上动脉
E. 胃后动脉来自脾动脉

正确答案：D。胃网膜右动脉来自肠系膜上动脉

解析：胃短动脉来自脾动脉（A对）。胃左动脉来自腹腔干（B对）。胃右动脉来自肝固有动脉（C对）。胃网膜右动脉来自胃十二指肠动脉（D错，为本题正确答案）。胃后动脉来自脾动脉（E对）。